有关小隐静脉的描述，错误的是
A. 有静脉瓣
B. 起自足背静脉弓
C. 行经外踝前方
D. 于小腿后面上行
E. 汇入腘静脉

正确答案：C。行经外踝前方

解析：小隐静脉有静脉瓣（A对）。在足外侧缘起自足背静脉弓（B对），经外踝后方（C错，为本题正确答案），沿小腿后面上行（D对）。注入腘静脉（E对）。